硫酸镁中毒时最早出现的是
A. 呼吸加快
B. 尿量减少
C. 呼吸减慢
D. 膝反射消失
E. 心率加快

正确答案：D。膝反射消失

解析：注射硫酸镁可以抑制中枢及外周神经系统，使骨骼肌、心肌和血管平滑肌松弛，从而发挥肌松作用和降压作用。但是硫酸镁注射的安全范围很窄，血镁过高即可抑制延髓呼吸中枢和血管运动中枢，引起呼吸抑制、血压骤降和心脏骤停。肌腱反射消失是呼吸抑制的先兆（D对），连续注射过程中应经常检查肌腱反射。